关于健康教育和健康促进关系的正确表述是
A. 健康教育是健康促进的重要组成部分
B. 健康促进减弱了健康教育的力度
C. 健康教育和健康促进是相同的概念
D. 健康教育比健康促进内涵更广泛
E. 健康促进是健康教育的重要组成部分

正确答案：A。健康教育是健康促进的重要组成部分